呈类圆形或椭圆形薄片，外表皮灰黄色灰黄色或灰褐色。切面黑色，微有光泽，有的具裂隙。气特异似焦糖，味甘、微苦的饮片是
A. 木香
B. 川木香
C. 玄参
D. 当归
E. 党参

正确答案：C。玄参

解析：本题考查玄参的性状鉴别。玄参（C对）【性状鉴别】饮片为类圆形或椭圆形薄片，外表皮灰黄色或灰褐色。切面黑色，微有光泽，有的具裂隙。气特异似焦糖，味甘、微苦。木香（A错）【性状鉴别】饮片木香：呈类圆形或不规则的厚片，外表皮黄棕色至灰褐色，有纵皱纹。切面棕黄色至棕褐色，中部有明显菊花心状的放射纹理，形成层环棕色，褐色油点（油室）散在。气香特异，味微苦。川木香（B错）【性状鉴别】饮片川木香：呈类圆形切片，直径1.5～3cm。外皮黄褐色至棕褐色，具纵皱纹及细筋脉纹。切面黄白色至黄棕色，有深棕色稀疏油点及裂隙，木部显菊花心状的放射纹理，有的中心呈枯朽状，形成层环明显。体较轻，质硬脆。气微香，味苦，嚼之粘牙。当归（D错）【性状鉴别】饮片当归：为类圆形、椭圆形或不规则薄片。外表皮浅棕色至棕褐色。切面黄白色或淡棕黄色，平坦，有裂隙，中间有淡棕色形成层环，并有多数棕色油点，质柔韧。香气浓郁，味甘、辛、微苦。党参（E错）【性状鉴别】党参片：呈类圆形的厚片，外表皮灰黄色、黄棕色至灰棕色，有的可见根头部有多数疣状突起的茎痕和芽。切面皮部淡棕黄色至黄棕色，木部淡黄色至黄色，有裂隙或放射状纹理。有特殊香气，味微甜。